微核试验的遗传学终点为
A. DNA完整性改变
B. 染色体完整性改变或染色体分离改变
C. 染色体交换或重排
D. 细胞分裂异常

正确答案：B。染色体完整性改变或染色体分离改变

解析：本题考查微核试验的遗传学终点。微核试验的遗传学终点为染色体完整性改变或染色体分离改变（B对ACD错）。